拟拔除右下8，经切开去骨后艰难拔除，拔除1周复诊，出现右下唇麻木，创口无感染，X线片示：牙槽窝底可见小骨片压迫下颌神经管，余未见异常。引起麻木的原因是
A. 麻醉时损伤神经
B. 手术切开时损伤神经
C. 拔牙中器械损伤神经
D. 骨折片压迫下颌神经管
E. 术后感染

正确答案：D。骨折片压迫下颌神经管

解析：本题考查牙拔除术中并发症-神经损伤。拔牙时由于拔牙用力不当，造成牙槽突骨折，骨折后压迫下颌神经管，下牙槽神经、血管通过下颌神经沟通入下颌孔，下颌孔前下方通入下颌管，压迫下颌神经管，导致神经损伤。X线片示：牙槽窝底可见小骨片压迫下颌神经管，故引起麻木的原因是骨折片压迫下颌神经管（D对）。